肝的脏面左纵沟的前部是
A. 胆囊窝
B. 腔静脉沟
C. 第2肝门
D. 静脉韧带裂
E. 肝圆韧带裂

正确答案：E。肝圆韧带裂

解析：肝圆韧带裂(E对)位于肝脏面左纵沟前部，胆囊窝(B错)位于右纵沟前部，腔静脉沟位于右纵沟后部，第2肝门(C错)位于腔静脉沟上端，静脉韧带裂(D错)位于左纵沟后部。